男，15岁，突起四肢无力2天。查体四肢肌力2级，肌张力低，腱反射消失，病理征未引出，无明显感觉障碍，双侧腓肠肌握痛。最可能的诊断是
A. 重症肌无力
B. 周期性麻痹
C. 吉兰－巴雷综合征
D. 多发性肌炎
E. 急性脊髓炎

正确答案：C。吉兰－巴雷综合征

解析：患者青少年男性，突起四肢无力2天，查体四肢肌力2级，肌张力低，对称性肌无力，腱反射消失，病理征未阴性，无明显感觉障碍，双侧腓肠肌握痛，考虑诊断为吉兰巴雷综合征（C对）。重症肌无力（A错）患者症状会有典型的“晨轻暮重”现象，会出现眼睑下垂等眼外肌麻痹表现，甚至会出现呼吸困难吞咽困难等呼吸肌和口咽肌受累的表现。周期性瘫痪（B错）表现为四肢无感觉障碍周期性发作的迟缓性瘫痪，伴有低血钾，多发性肌炎（D错）除了肌无力等表现为，还会出现皮疹等皮肤损害以及消化道、心脏、肾脏等多器官受损表现。急性脊髓炎（E错）表现为脊髓横断性损害，受损平面以下完全瘫痪。